男，35岁，从高处跳下时，双下肢顿时感到无力如果检查显示胸椎压缩性骨折超过lcm，并有骨块进入椎管，应采取的治疗方法是
A. 牵引
B. 仰卧硬板床，背部垫高
C. 双桌法过伸复位
D. 早期背伸锻炼
E. 及早手术解除脊髓压迫

正确答案：E。及早手术解除脊髓压迫

解析：患者高处跳下后，双下肢顿时感到无力（提示可能有脊髓损伤），检查示胸椎压缩性骨折超过lcm，并有骨块进入椎管（提示可能损伤脊髓），结合患者病史、临床表现及检查，该患者最可能的诊断为胸椎压缩性骨折伴脊髓损伤，考虑到患者椎管内有骨块进入，为防止加重脊髓损伤，应及早手术解除脊髓压迫（E对）。牵引（A错）多用于颈椎半脱位的治疗。仰卧硬板床，背部垫高（B错）及早期背伸锻炼（D错）均为轻度压缩骨折患者非手术治疗措施。双桌法过伸复位（C错）多用于Chance骨折的治疗。